城市区域环境质量评价的核心内容是
A. 污染源调查评价
B. 环境质量调查评价
C. 环境效应调查评价
D. 环境质量综合评价
E. 环境污染综合防治方案

正确答案：B。环境质量调查评价

解析：本题考查城市区域环境质量评价的核心内容。城市区域环境质量评价的核心内容是环境质量调查评价（B对ACDE错）。在对该区域内较重要的几项环境因素进行调查和监测的基础上，采用数理统计方法对监测数据作分析整理，然后依据环境卫生标准或环境质量标准进行评价。